以下关于牙龈癌的描述，不正确的是
A. 多为分化度较高的鳞状细胞癌
B. 生长较慢，以溃疡型为最多见
C. 上牙龈癌因颌骨血供丰富，远处转移较多见
D. 下牙龈癌多转移到患侧下颌下及颏下淋巴结，以后到颈深淋巴结
E. 一般不适于放射治疗

正确答案：C。上牙龈癌因颌骨血供丰富，远处转移较多见

解析：下牙龈癌比上牙龈癌淋巴结转移早，同时也较多见。下牙龈癌多转移到患侧下颌下及颏下淋巴结，以后到颈深淋巴结；上牙龈癌则转移到患侧下颌下及颈深淋巴结。远处转移比较少见。治疗以外科手术为主。对放射治疗不敏感。掌握“鳞状细胞癌概述及舌癌、牙龈癌”知识点。